对眼睛刺激作用最强的是
A. 臭氧
B. 铅
C. 硒
D. 甲醛
E. 苯并（a）芘

正确答案：D。甲醛

解析：本题考查对眼睛刺激作用最强的物质。甲醛是一种毒性较大的物质，在我国有毒化学品优先控制名单上甲醛高居第二位。当室内甲醛浓度达到一定剂量的时候，就会对人体健康产生危害。甲醛（D对ABCE错）对眼睛的刺激作用最强，它可以引起眼睛痛、红肿、流泪、视力下降等症状，甚至可能导致失明。